不属于股骨近端的结构
A. 股骨头
B. 股骨颈
C. 小转子
D. 髁间窝
E. 转子间线

正确答案：D。髁间窝

解析：髁间窝属于股骨远端的结构，是两踝后份之间的深窝（D错，为本题正确答案）。股骨头（A对）、股骨颈（B对）、小转子（C对）、转子间线（E对）均属于股骨近端的结构。